下列哪项不直接影响细胞内氧化磷酸化的速率
A. 呼吸链电子传递速度
B. ATP合酶活性
C. ADP水平
D. 细胞内解耦联
E. 蛋白激酶的作用

正确答案：E。蛋白激酶的作用

解析：ATP作为机体最主要的能量载体，其生成量主要取决于氧化磷酸化的速率。机体根据自身能量需求通过调节氧化磷酸化的速率来调节 ATP的合成，因此，能够影响NADH、FADH2的产生、影响呼吸链组分和ATP合酶功能的因素，都会影响氧化磷酸化进而影响ATP的生成。解偶联剂阻断ADP的磷酸化过程（ABCD对）。蛋白激酶的作用不直接影响细胞内氧化磷酸化的速率（E错，为本题的正确答案）。